产褥期抑郁症心脾两虚证治疗方剂为
A. 甘麦大枣汤合归脾汤
B. 逍遥散
C. 癫狂梦醒汤
D. 百合地黄汤
E. 越鞠丸

正确答案：A。甘麦大枣汤合归脾汤

解析：产褥期抑郁症的心脾两虚证主因产后思虑太过，心血暗耗，脾气受损，气血生化不足，血不养心，心神失养所致。治宜补益心脾，养血安神，方用养心安神，和中缓急的甘麦大枣汤合益气补血，健脾养心的归脾汤（A对）。产褥期抑郁症肝郁气结证的治疗方剂为逍遥散（B错）《太平惠民和剂局方》加夜交藤、合欢皮、磁石、柏子仁；产褥期抑郁症痰阻气逆证的治疗方剂为癫狂梦醒汤（C错）《医林改错》加酸枣仁；百合地黄汤（D错）滋阴清热，主治百合病；越鞠丸（E错）行气解郁，治疗六郁证。